主动脉腹部自上而下发出脏支的顺序正确的是
A. 腹腔干、肠系膜上动脉、精索内动脉、肾动脉、肠系膜下动脉
B. 腹腔干、肠系膜上动脉、肾动脉、精索内动脉、肠系膜下动脉
C. 肠系膜上动脉、腹腔干、肾动脉、精索内动脉、肠系膜下动脉
D. 腹腔干、肾动脉、肠系膜上动脉、精索内动脉、肠系膜下动脉
E. 肠系膜上动脉、腹腔干、肾动脉、肠系膜下动脉、精索内动脉

正确答案：B。腹腔干、肠系膜上动脉、肾动脉、精索内动脉、肠系膜下动脉

解析：腹腔干、肠系膜上动脉、肾动脉、精索内动脉、肠系膜下动脉（B对）为主动脉腹部自上而下发出脏支的正确顺序。